健康促进的核心策略是
A. 监测监督
B. 监督评估
C. 群众参与
D. 社会动员
E. 组织领导

正确答案：D。社会动员